香薷除发汗利水外，又能
A. 宣肺平喘
B. 透疹止痒
C. 化湿和中
D. 燥湿止带
E. 通窍止痛

正确答案：C。化湿和中

解析：本题考查的是香薷的功效。香薷除发汗利水外，又能化湿和中（C对）。香薷：【功效】发汗解表，和中化湿，利水消肿。麻黄：【功效】发汗解表，宣肺平喘（A错），利水消肿。荆芥：【功效】散风解表，透疹止痒（B错），止血。白芷：【功效】发散风寒，通窍止痛（E错），燥湿止带（D错），消肿排脓。